属于一级预防的是
A. 改变工艺，改变原材料和设备
B. 定期职业性健康检查
C. 使用优质原料、保证产品质量
D. 对已患病者正确诊断，及时处理，积极治疗
E. 毒代动力学研究

正确答案：A。改变工艺，改变原材料和设备